肝的主要功能是分泌胆汁、参与代谢、贮存糖原、解毒及吞噬防御等，胚胎时期还有造血功能。肝呈楔形，分为上、下2面和前、后、左、右4缘。肝的上面隆凸，与膈相接，称膈面。膈面被镰状韧带分为大而厚的右叶和小而薄的左叶。肝下面凹凸不平，与腹腔脏器相邻，称脏面。脏面有一近似“H”形的沟，即２条矢状位的左、右纵沟和１条冠状位的横沟。肝的形态和位置错误的是
A. 呈楔形
B. 活体呈红褐色，质软而脆
C. 膈面隆凸，被冠状韧带分为右叶和左叶
D. 大部分位于右季肋区和腹上区
E. 肝脏面的横沟为肝门

正确答案：C。膈面隆凸，被冠状韧带分为右叶和左叶

解析：肝呈楔形(A对)，活体呈红褐色，质地软而脆(B对)，膈面隆凸，被镰状韧带分为右叶和左叶(C错，为本题正确答案)，大部分位于右季肋区和腹上区(D对)，肝脏面中部的横沟为肝门(E对)。